代偿性呼吸性酸中毒
A. pH7.38，PaO₂50mmHg，PaCO₂40mmHg
B. pH7.30，PaO₂50mmHg，PaCO₂80mmHg
C. pH7.40，PaO₂60mmHg，PaCO₂65mmHg
D. pH7.35，PaO₂80mmHg，PaCO₂20mmHg
E. pH7.25，PaO₂70mmHg，PaCO₂30mmHg

正确答案：C。pH7.40，PaO₂60mmHg，PaCO₂65mmHg

解析：机体通过肺、肾来维持酸碱平衡，这是一个动态平衡的过程。当发生呼吸性酸中毒时，机体通过肾脏的排酸保碱功能来维持血液pH的稳定。本题为代偿性呼吸性酸中毒，机体的pH仍然维持在正常范围7.35～7.45（BE错），呼吸性酸中毒患者PaCO₂增高＞45mmHg（ADE错），所以只有pH7.40，PaO₂60mmHg，PaCO₂65mmHg（C对ABDE错）符合代偿性呼吸性酸中毒的指标。